下列哪种说法为双向性队列研究设计的特点
A. 在回顾性队列研究的基础上进行前瞻性队列研究
B. 因为研究设计中包括回顾性研究，因此不能做出病因推断
C. 需长期随访，研究代价太高，因此不实用
D. 易控制潜在的混杂因子
E. 通常省时、省力

正确答案：A。在回顾性队列研究的基础上进行前瞻性队列研究

解析：本题考查双向性队列研究的原理。双向性队列研究即在历史性队列研究的基础上，继续前瞻性观察一段时间（A对BCDE错），它是将前瞻性队列研究与历史性队列研究结合起来的一种设计模式，因此兼有上述两类的优点，且相对地在一定程度上弥补了各自的不足。